用钝头牙周探针探测牙周炎患牙的炎症牙龈时，探针终止于
A. 龈沟底
B. 进入结合上皮1/2～1/3处
C. 穿透结合上皮，终止于正常结缔组织的冠方
D. 终止于正常结缔组织纤维内
E. 终止于结合上皮的冠方

正确答案：C。穿透结合上皮，终止于正常结缔组织的冠方

解析：本题考查探测龈沟深度。用钝头牙周探针探测牙周炎患牙的炎症牙龈时，探针终止于穿透结合上皮，终止于正常结缔组织的冠方（C对）。当探测龈沟深度时，还应考虑到炎症的影响。组织学研究证明，用钝头的牙周探针探测健康的龈沟时，探针并不终止于结合上皮的最冠方（即组织学的龈沟底位置），而是进入到结合上皮内约1/3～1/2处（B错）。当探测有炎症的牙龈时，探针尖端会穿透结合上皮而进入有炎症的结缔组织内，终止于炎症区下方的正常结缔组织纤维的冠方。这是因为在炎症时结缔组织中胶原纤维破坏消失，组织对机械力的抵抗减弱，易被探针穿通。消炎后，结缔组织中胶原纤维新生，组织的致密度增加，探针不再穿透到结缔组织中，故探诊深度减小。因此，在炎症明显的部位，临床牙周探诊的深度大于组织学上的龈沟（袋）深度。